下列何者不是尘肺
A. 煤肺
B. 石棉肺
C. 棉尘肺
D. 煤矽肺
E. 矽肺

正确答案：C。棉尘肺

解析：本题考查尘肺的类型。尘肺是由于在生产环境中长期吸入生产性粉尘而引起的以肺组织纤维化为主的疾病。煤肺（A对）、石棉肺（B对）、煤矽肺（D对）、矽肺（E对）都属于尘肺。棉尘肺（C错，为本题正确答案）一般指棉屑沉着病，是由于吸入棉尘、亚麻尘、软木尘引起支气管收缩和肺功能损害的一种呼吸道阻塞性疾病。